阑尾动脉起自
A. 肠系膜上动脉
B. 肠系膜下动脉
C. 右结肠动脉
D. 回结肠动脉
E. 无

正确答案：D。回结肠动脉

解析：回结肠动脉（D对）至阑尾的分支称阑尾动脉，经回肠末端的后方进入阑尾系膜，分支营养阑尾。